细菌性尿路感染，最常见的致病菌是
A. 肠球菌
B. 铜绿假单胞菌
C. 克雷伯杆菌
D. 大肠埃希菌
E. 葡萄球菌

正确答案：D。大肠埃希菌

解析：本题考查尿路感染。尿路感染以细菌感染为主，在细菌感染中，革兰阴性杆菌最常见，其中以大肠埃希菌（D对）最为常见，约占全部尿路感染的85%。肠球菌（A错）、铜绿假单胞菌（B错）、克雷伯杆菌（C错）、葡萄球菌（E错）均不符合题意。